依照《麻醉药品和精神药品管理条例》的规定，麻醉药品处方至少保存
A. 一年
B. 二年
C. 三年
D. 四年
E. 五年

正确答案：C。三年

解析：本题考查麻醉药品和第一类精神药品的处方资格及处方管理。依照《麻醉药品和精神药品管理条例》的规定，麻醉药品处方至少保存三年（C对）。麻醉药品和第一类精神药品的处方资格及处方管理：1.医疗机构应当按照国务院卫生健康主管部门的规定，对本单位执业医师进行有关麻醉药品和精神药品使用知识的培训、考核，经考核合格的，授予麻醉药品和第一类精神药品处方资格。执业医师取得麻醉药品和第一类精神药品的处方资格后，方可在本医疗机构开具麻醉药品和第一类精神药品处方，但不得为自己开具该种处方。2.医疗机构应当将具有麻醉药品和第一类精神药品处方资格的执业医师名单及其变更情况，定期报送所在地设区的市级卫生行政部门，并抄送同级药品监督管理部门。3.执业医师应当使用专用处方开具麻醉药品和精神药品，单张处方的最大用量应当符合国务院卫生主管部门的规定。对麻醉药品和第一类精神药品处方，处方的调配人、核对人应当仔细核对，签署姓名，并予以登记；对不符合处方管理规定的，处方的调配人、核对人应当拒绝发药。4.医疗机构应当对麻醉药品和精神药品处方进行专册登记，加强管理。麻醉药品处方至少保存3年，精神药品处方至少保存2年。